地西泮需要检查的特殊杂质
A. 游离水杨酸
B. 酮体
C. 游离肼
D. 光降解产物
E. 二苯酮衍生物

正确答案：E。二苯酮衍生物

解析：本题考查特殊杂质的检查。地西泮需要检查的特殊杂质为二苯酮衍生物（E对）。